患者，男，50岁。发现胃癌1个月。胃脘嘈杂灼热，食后痛胀，口干咽燥，五心烦热，舌红绛少苔，脉细数，应考虑的治疗方剂是
A. 海藻玉壶汤
B. 柴胡疏肝散
C. 理中汤合四君子汤
D. 玉女煎
E. 开郁二陈汤

正确答案：D。玉女煎

解析：胃中积热，故见胃脘嘈杂灼热，食后痛胀；灼伤津液则口干咽燥；五心烦热，舌红绛少苔，脉细数，均属于阴虚之候，治法为清热和胃，滋阴润燥，治疗应先考虑的方药是玉女煎加减（D对）。海藻玉壶汤（A错）能化痰软坚，理气散结，用于治疗瘿瘤初起。柴胡疏肝散（B错）能疏肝行气，活血止痛，用于治疗肝胃不和证。理中汤合四君子汤（C错）温中怯寒，补气健脾，用于治疗脾胃虚寒证。开郁二陈汤（E错）可以燥湿健脾，消痰和胃，用于治疗气郁经闭证。